关于水痘，下列叙述中不正确的是
A. 冬春季节多见
B. 传染性强
C. 病后可由持久性免疫，不再发生水痘
D. 主要见于儿童
E. 与带状疱疹接触不会引起水痘

正确答案：E。与带状疱疹接触不会引起水痘